某患者，60岁。右下6因松动于三个月前拔除，要求修复。患牙拔除后修复的最好时间是
A. 4周
B. 1个月
C. 2个月
D. 3个月
E. 4个月

正确答案：D。3个月

解析：本题考查局部义齿的设计。一般拔牙后牙槽骨吸收较快，以后逐渐趋于稳定，通常在拔牙3个月（D对）左右制作。